通过阻断H₂受体而抑制胃酸分泌的药物是
A. 苯海拉明
B. 雷尼替丁
C. 氯苯那敏
D. 阿司咪唑
E. 奥美拉唑

正确答案：B。雷尼替丁

解析：本题考查雷尼替丁。通过阻断H₂受体而抑制胃酸分泌的药物是雷尼替丁（B对）。雷尼替丁为H₂受体阻断剂，其他的H₂受体阻断剂有西咪替丁、法莫替丁等。苯海拉明（A错）、氯苯那敏（C错）和阿司咪唑（D错）均为H₁受体阻断药。奥美拉唑（E错）为质子泵抑制剂，口服后可浓集于壁细胞分泌小管周围，转变为有活性的次磺酰胺衍生物。其硫原子与H⁺，K⁺-ATP酶上的巯基结合，使H⁺泵失活，减少胃酸分泌。